采用随机、对照和双盲实验研究方法的文献属于
A. 五级证据
B. 四级证据
C. 三级证据
D. 二级证据
E. 一级证据

正确答案：D。二级证据

解析：本题考查循证医学证据的分级。各类医学研究提供的证据根据质量和可靠性的不同，可划分为不同的级别，将证据大体分为五级。①一级（E错）：收集所有质量可靠的多个随机对照实验的系统评价或Meta分析；②二级（D对）：样本含量足够大的单个随机对照实验结果；③三级（C错）：前瞻性队列研究和病例回顾或观察；④四级（B错）：无对照的系列病例回顾或观察；⑤五级（A错）：专家的意见和观点。